风热感冒应采用的治法是
A. 辛温宣肺解表
B. 凉血养阴解表
C. 清热宣肺解表
D. 散风除湿解表
E. 益气清热解表

正确答案：C。清热宣肺解表

解析：本题考查的是感冒的辨证论治。风热感冒应采用的治法是清热宣肺解表（C对）。风热感冒：【治法】辛凉解表，宣肺清热。辛温宣肺解表（A错）为风寒感冒的治法。风寒感冒：【治法】辛温解表，宣肺散寒。治法为凉血养阴解表（B错）、散风除湿解表（D错）或益气清热解表（E错）的病证，2022年考试指南未明确说明。